以上哪种药物有腐蚀性
A. 再矿化液
B. 硝酸银溶液
C. 75%氟化钠甘油糊剂
D. 8%氟化亚锡溶液
E. 1.5%含氟凝胶

正确答案：B。硝酸银溶液

解析：硝酸银溶液对软组织有很强的腐蚀性，只用于乳牙和后牙，不用于牙颈部龋，避免对牙龈的损伤。掌握“龋病的治疗原则与非手术治疗方法”知识点。